下列哪项为用途广泛的假设检验方法，可用于两个及两个以上率或构成比的比较；两分类变量间相关关系分析等。
A. 卡方检验
B. t检验
C. 标准误
D. 方差检验
E. 标准差检验

正确答案：A。卡方检验

解析：卡方检验是用途非常广泛的一种假设检验方法，它可用于两个及两个以上率或构成比的比较；两分类变量间相关关系分析等。掌握“分类资料的统计描述与推断”知识点。